下列哪项不包括在休克的治疗原则中
A. 尽早去除引起休克的原因
B. 尽快恢复有效血容量
C. 增进心脏功能
D. 纠正微循环障碍
E. 及时应用血管扩张剂

正确答案：E。及时应用血管扩张剂

解析：休克的治疗原则，是尽早去除引起休克的原因，尽快恢复有效循环血量，纠正微循环障碍，增进心脏功能和恢复人体的正常代谢。对于感染性休克宜采取升压药物。掌握“休克”知识点。